婴幼儿患者合理应用中药的原则有
A. 用量宜轻
B. 宜用轻清之品
C. 宜用健脾和胃之品
D. 宜用滋补之品
E. 宜佐凉肝定惊之品

正确答案：A、B、C、E。用量宜轻；宜用轻清之品；宜用健脾和胃之品；宜佐凉肝定惊之品

解析：本题考查的是婴幼儿患者合理应用中药的原则。婴幼儿患者合理应用中药的原则有用量宜轻（A对）、宜用轻清之品（B对）、宜用健脾和胃之品（C对）与宜佐凉肝定惊之品（E对）。婴幼儿患者合理应用中药的原则：1.用药及时，用量宜轻。2.宜用轻清之品。3.宜佐健脾和胃之品。4.宜佐凉肝定惊之品。5.不宜滥用滋补之品（D错）。